患者，女，32岁，已婚。现停经45天，尿妊娠试验阳性。2小时前因与爱人吵架出现左下腹撕裂样剧痛，伴肛门坠胀，面色苍白。查体血压80/50mmHg，左下腹压痛、反跳痛明显，有移动性浊音，阴道有少量出血。应首先考虑的是
A. 小产
B. 堕胎
C. 胎动不安
D. 异位妊娠
E. 妊娠腹痛

正确答案：D。异位妊娠

解析：小产为胎儿在妊娠12~28周内，胎儿已经成形而自然殒堕者，题中仅6~7周（A错）。堕胎为妊娠12周内，胚胎自然殒堕者。患者多在妊娠12周内，出现阴道出血，血量增多超过月经量，继而小腹疼痛加重，胚胎自然殒堕，题中患者阴道仅少量出血，且胚胎未殒堕（B错）。胎动不安为妊娠期间出现腰酸、腰痛、小腹下坠或伴少量阴道出血者，题中患者无腰酸、腰痛、小腹下坠的症状，且胎动不安小腹疼痛不甚明显，血压多不改变，而异位妊娠破损型为突发剧烈疼痛，血压下降（C错）。题中患者尿妊娠试验阳性，有6周多的停经史，下腹突发剧烈撕裂样疼痛，血压下降，阴道有少量出现，下腹部有压痛及反跳痛，有移动性浊音，首选考虑异位妊娠（D对）。妊娠腹痛为因胞脉阻滞或失养，发生小腹疼痛者阴道多无出现，多无反跳痛，且疼痛无撕裂样痛剧烈，血压多不下降（E错）。